下列关于实性或多囊型成釉细胞瘤的描述错误的是
A. 瘤可沿松质骨的骨小梁间隙向周围浸润
B. 手术不充分容易复发
C. 多见于下颌磨牙区和升支部
D. X线可表现为单房或多房性透射影
E. 肿瘤边界不清楚

正确答案：E。肿瘤边界不清楚

解析：实性或多囊型成釉细胞瘤：是指经典的骨内型成釉细胞瘤，可沿松质骨的骨小梁间隙向周围浸润，其波及范围往往超越X线所示的肿瘤边缘，若手术不充分极易复发。X线可表现为单房或多房性透射影，边界清楚，可见硬化带。掌握“成釉细胞瘤”知识点。